下列哪项不能作为肺心病的诊断依据
A. 肺动脉瓣第二心音亢进
B. 心尖搏动剑突下明显
C. 肝肋下3cm
D. 肝颈回流征阳性
E. 下肢水肿

正确答案：C。肝肋下3cm